因含罂粟壳而不能过量或长期服用的中成药是
A. 蛇胆陈皮胶囊
B. 克咳胶囊
C. 桂龙咳喘宁胶囊
D. 二母宁嗽丸
E. 蜜炼川贝枇杷膏

正确答案：B。克咳胶囊

解析：本题考查的是含毒性成分的中成药。因含罂粟壳而不能过量或长期服用的中成药是克咳胶囊（B对）。克咳胶囊含毒性成分是罂粟壳。蛇胆陈皮胶囊（A错）组成：蛇胆汁，陈皮。桂龙咳喘宁胶囊（C错）组成：桂枝，龙骨，白芍，生姜，大枣，炙甘草，牡蛎，黄连，法半夏，瓜蒌皮，苦杏仁（炒）。二母宁嗽丸（D错）组成：川贝母、知母、石膏、炒栀子、黄芩、蜜桑白皮、茯苓、炒瓜蒌子、陈皮、麸炒枳实、炙甘草、五味子（蒸）。蜜炼川贝枇杷膏（E错）组成：川贝母、枇杷叶、桔梗、陈皮、水半夏、北沙参、五味子、款冬花、杏仁水、薄荷脑。辅料为蔗糖、蜂蜜。